好发于下颌第三磨牙区及下颌支部
A. 含牙囊肿
B. 根端囊肿
C. 始基囊肿
D. 皮样囊肿
E. 甲状舌管囊肿

正确答案：C。始基囊肿

解析：始基囊肿、角化囊肿则好发于下颌第三磨牙区及下颌支部。掌握“牙源性颌骨囊肿”知识点。